适用于非缺隙侧，相邻两牙之间有间隙者
A. 倒钩卡环
B. 三臂卡环
C. 连续卡环
D. 联合卡环
E. 对半卡环

正确答案：D。联合卡环

解析：联合卡环：由两个卡环通过共同的卡环体连接而成。卡环体位于相邻两基牙的（牙合）外展隙，并与伸向（牙合）面的（牙合）支托相连接。适用于非缺隙侧，基牙牙冠短而稳固，或相邻两牙之间有间隙者，联合卡环还可用于防止食物嵌塞。掌握“局部义齿固位体”知识点。